女婴，1个月。生后间断呕吐，呕吐物为奶液，体重增长不满意。查体：可见胃蠕动波，右上腹触及包块。最可能的诊断是
A. 幽门痉挛
B. 胃扭转
C. 先天性肥厚性幽门狭窄
D. 先天性巨结肠
E. 胃食管反流

正确答案：C。先天性肥厚性幽门狭窄

解析：女性幼儿患者，生后间断呕吐（先天性肥厚性幽门狭窄的主要症状），呕吐物为奶液，体重增长不满意。查体：可见胃蠕动波，右上腹触及包块（先天性肥厚性幽门狭窄的特有体征）。综合患者的症状、体征，最可能的诊断是先天性肥厚性幽门狭窄（C对）。幽门痉挛（A错）多在生后即出现间歇性不规则呕吐，不多，无进行性加重，偶见胃蠕动波，但右上腹摸不到肿块。胃扭转（B错）患者常有持续性的干呕而呕吐物甚少。先天性巨结肠（D错）胎便排出延缓、顽固性便秘和腹胀，可出现呕吐，量不多，呕吐物含少量胆汁，严重者可见粪样液。胃食管反流（E错）呕吐为非喷射性，上腹无蠕动波，无右上腹橄榄样肿块。